下列哪项属于系统综述特有的偏倚
A. 入院率偏倚
B. 现患病例-新发病例偏倚
C. 检出症候偏倚
D. 文献检索偏倚
E. 无应答偏倚

正确答案：D。文献检索偏倚